女，21岁。因工作紧张，近一个月感觉压力重重，不能胜任工作，觉的自己一无是处，连累了父母，开煤气自杀被急送入院。入院后又趁人不备打破窗玻璃，用碎玻璃自杀，后经抢救脱险。经检查患者有青光眼病史。该患者首选药物是
A. 碳酸锂
B. 西太普兰
C. 丙戊酸钠
D. 阿普唑仑
E. 阿米替林

正确答案：B。西太普兰

解析：该病患近一个月（病程持续时间大于2周）觉得自己一无是处（自我评价低，无价值感），连累了父母（自罪观念），开煤气自杀，入院后又趁人不备用碎玻璃自杀（自杀观念和行为），最可能的诊断为抑郁症，首选抗抑郁药物（西酞普兰和阿米替林），由于检查患有青光眼，禁用阿米替林（三环类抗抑郁药物可引起眼压升高）（B对C错）。碳酸锂是最常见的心境稳定剂（抗躁狂药物），主要用于躁狂发作（A错）。